既收敛又温中的药物是
A. 芡实
B. 诃子
C. 肉豆蔻
D. 罂粟壳
E. 乌梅

正确答案：C。肉豆蔻

解析：本题考查的是肉豆蔻的性能特点。既收敛又温中的药物是肉豆蔻（C对）。肉豆蔻：【性能特点】本品温而涩敛，辛香燥散，入脾、胃、大肠经。既善温中涩肠，治阳虚久泻；又能温中行气，治虚寒气滞，实为标本兼顾之品。【功效】涩肠止泻，温中行气。芡实（A错）：【性能特点】本品甘补涩敛，平而不偏，入脾、肾经，药力平和。能补脾兼祛湿，益肾兼固精，有补而不腻、涩而不留湿之长，主治脾虚久泻及肾虚下元不固诸证。【功效】补脾祛湿，益肾固精。诃子（B错）：【性能特点】本品苦能泄降，酸涩收敛，苦多于酸，入肺与大肠经，生用、煨用性能有别。煨用平偏温，善涩肠下气而消胀止泻，久泻久痢有寒兼腹胀者宜用。生用平偏凉，善敛肺下气降火而止咳逆、利咽、开音，咳逆兼咽痛喑哑者宜用。与乌梅相比，虽均敛肺涩肠，但生用平偏凉，善苦降而降火下气、利咽开音。【功效】涩肠，敛肺，下气，利咽。罂粟壳（D错）：【性能特点】本品酸涩收敛，平而偏温，有毒力强，既入肺、肾经，又入大肠经。善敛肺而止咳，能涩肠而止泻，且止痛力强，为治痛证要药。然有毒易成瘾，故内服宜谨慎。【功效】敛肺，涩肠，止痛。乌梅（E错）：【性能特点】本品酸敛生津，性平不偏，既入肝、脾经，又入肺与大肠经。上敛肺气以止咳，下涩大肠以止泻，并能收敛以止血。又因酸味独重，还善安蛔、生津。【功效】敛肺，涩肠，生津，安蛔，止血。